临床可取代林可霉素应用
A. 红霉素
B. 罗红霉素
C. 克拉霉素
D. 克林霉素
E. 四环素

正确答案：D。克林霉素

解析：本题考查克林霉素。克林霉素（D对）是林可霉素的半合成衍生物，两者抗菌谱相同，克林霉素可替代林可霉素使用。